药物以微晶形式分散于载体中成为物理混合物的固体分散体类型是
A. 固态溶液
B. 玻璃混悬液
C. 玻璃溶液
D. 共沉淀物
E. 低共熔混合物

正确答案：E。低共熔混合物

解析：本题考查的是固体分散体的类型。药物以微晶形式分散于载体中成为物理混合物的固体分散体类型是低共熔混合物（E对）。固体分散体的类型：按药物的分散状态固体分散体可分为：①低共熔混合物。药物以微晶形式分散于载体中成为物理混合物。②固态溶液（A错）。药物以分子状态溶解在固体载体中形成均相体系。固态溶液中药物的分散度往往比低共熔混合物中的更高，因此，其溶出速度较快。③玻璃溶液（C错）或玻璃混悬液（B错）。药物溶于熔融的透明状的无定形载体中，骤然冷却，得到质脆透明状态的固体溶液或混悬液。④共沉淀物（D错）。固体药物与载体以适当比例形成的非结晶性无定形物。药物在固体分散体中的分散状态不一定以上述某一种方式单独存在，往往是多种类型的混合体。